《中国药典》罗布麻叶的含量测定是
A. 槲皮苷
B. 金丝桃苷
C. 齐墩果酸
D. 番泻苷
E. 靛玉红

正确答案：B。金丝桃苷

解析：本题考查的是罗布麻叶的含量测定。《中国药典》罗布麻叶的含量测定是金丝桃苷（B对）。罗布麻叶【含量测定】本品按干燥品计算，含金丝桃苷不得少于0.30%。番泻叶【含量测定】本品按干燥品计算，含番泻苷（D错）A的番泻苷B的总量，不得少于1.1%。大青叶【含量测定】用高效液相色谱法测定，按干燥品计算，含靛玉红（E错）不得少于0.020%。